适合于牙间乳头退缩、邻面凹陷处的菌斑清除法为
A. 牙线
B. 牙签
C. 牙间隙刷
D. 水平颤动法刷牙
E. 电动牙刷刷牙

正确答案：C。牙间隙刷

解析：牙间刷适用于龈乳头丧失的邻间区，以及暴露的根分叉区和排列不整齐的牙邻面。特别是对去除颈部和根面上附着的菌斑比牙线和牙签更有效，使用起来比牙线方便。牙间刷分刷毛和持柄两部分。刷毛插在持柄上，可经常更换。掌握“菌斑控制及提高宿主抵抗力”知识点。